女，43岁。乏力、厌食、嗜睡5年，逐渐加重2年。20年前产后大出血休克、昏迷7小时，产后闭经至今。具体治疗不详，近3年多中断治疗。首选的治疗药物是
A. 雌激素
B. 血管加压素
C. 左旋甲状腺素钠
D. 肾上腺皮质激素
E. 孕激素

正确答案：D。肾上腺皮质激素

解析：该患者为中年女性，20年前产后大出血休克，昏迷7小时，产后闭经至今。乏力，厌食，嗜睡5年，逐渐加重2年（希恩综合征引起腺垂体功能低下，表现为畏寒、嗜睡、低血压），最可能诊断为希恩综合征。由于产后大出血休克，导致垂体尤其是腺垂体促性腺激素分泌细胞缺血坏死，引起腺垂体功能低下，从而引起促肾上腺皮质激素分泌减少，最终导致肾上腺皮质激素分泌减少，故首选的治疗药物是肾上腺皮质激素（D对）。雌激素（A错）、孕激素（E错）补充的治疗目的主要是：维持女性体内雌孕激素水平，调节月经周期和维持第二性征，主要用于闭经、功血的治疗。血管加压素（B错）主要用于尿崩症的患者。左旋甲状腺素钠（C错）主要用于甲状腺功能减退的患者。